人体试验中知情同意原则中不包括
A. 如实向受试者讲明试验的目标方法
B. 如实向患者说明试验潜在的危险
C. 受试者可以随时退出试验
D. 如实向受试者讲明预期的好处
E. 患者退出试验后会影响到合理的治疗

正确答案：E。患者退出试验后会影响到合理的治疗

解析：人体试验中知情同意原则中包括尊重受试者自我决定权，为保障此原则的实现，要做到事前无胁迫，事后无不利影响（E错，为本题正确答案）。全面维护受试者的知情权，应如实告知关于试验的基本信息，在内容上至少包括：研究目的和方法（例如双盲法、对照组、随机抽样等）（A对）；研究的持续时间；合理预期的受益（D对）；可预见的风险和不适（B对）；有益的替代治疗方法；受试者资料的保密程度；研究者为受试者提供医疗服务责任的大小；对因研究而导致的伤害所提供的免费治疗；对因研究而导致的残疾或死亡的赔偿义务；受试者拒绝参加研究及随时退出研究的权利等（C对）。